甲状腺核素检查呈冷结节是
A. graves病
B. 亚急性甲状腺炎
C. 甲状腺癌
D. 甲状腺乳头状囊性腺样瘤瘤内出血
E. 甲状腺高功能腺瘤

正确答案：C。甲状腺癌

解析：本题考查甲状腺结节的鉴别诊断。甲状腺核素检查呈冷结节是甲状腺癌（C对）。行放射性131I扫描时，将结节的放射性密度与周围正常甲状腺组织的放射性密度进行比较：密度较正常增高者为热结节，与正常相等者为温结节，较正常减弱者为凉结节，完全缺如者为冷结节。甲状腺癌均为冷结节，边缘一般较模糊；结节性甲状腺肿囊性变时也可表现为冷结节，但边缘多较清晰；甲状腺腺瘤可表现为温结节、凉结节，边缘清晰或模糊；热结节多为高功能腺瘤（E错）。甲状腺囊性变（D错）及部分癌为冷结节。